咸味所示的作用是
A. 活血
B. 利水
C. 收敛
D. 燥湿
E. 软坚

正确答案：E。软坚

解析：本题考查五味的所示效用及临床应用。咸味所示的作用是软坚（E对）。咸：能软、能下，有软坚散结、泻下通便作用，如治瘰疬、痰核的昆布、海藻，治癥瘕的鳖甲，治热结便秘的芒硝等，均具咸味。辛：能散、能行，有发散、行气、活血（A错）作用。如治表证的荆芥、薄荷，治气滞的香附，治血瘀的川芎等，都具有辛味。淡：能渗、能利，有渗湿利水（B错）作用，如治水肿、小便不利的猪苓、茯苓，均具淡味。常将淡附于甘。酸：能收、能涩，有收敛（C错）固涩作用。如治自汗盗汗、遗精滑精的五味子，治久泻久痢的五倍子，治久咳的乌梅，治大汗虚脱、崩漏经多的山茱萸等，均具酸味。另外，酸能生津、安蛔，如木瓜、乌梅等。苦：能泄、能燥、能坚。其中，能泄的含义有三：一指苦能通泄，如大黄苦寒，功能泻热通便，治热结便秘每用。二指苦能降泄，如苦杏仁味苦降泄肺气，治咳喘气逆必投；代赭石味苦而善降逆，治呃逆呕喘常选。三指苦能清泄，如黄连、栀子味苦，能清热泻火，治火热内蕴或上攻诸证宜择。能燥即指苦能燥湿（D错），如治寒湿的苍术、厚朴，治湿热的黄柏、苦参等，均为苦味。能坚的含义有二：一指苦能坚阴，意即泻火存阴，如黄柏、知母即是；二指坚厚肠胃，如投用少量苦味的黄连，有厚肠止泻的作用等。